腹部闭合性损伤患者伴休克，腹部穿刺抽出不凝血。在尚未手术前应采用的最主要的治疗环节是
A. 保持安静
B. 止痛
C. 防治休克
D. 胃肠减压
E. 应用抗生素

正确答案：C。防治休克

解析：腹腔穿刺抽出不凝血，提示实质性器官破裂出血，而且患者已出现休克，应立即手术剖腹探查。术前最主要的治疗是积极扩容，防治休克（C对），为手术争取时间。保持安静（A错）、胃肠减压（D错）为一般辅助治疗，不是患者最主要的治疗环节。对尚未明确诊断的腹部损伤患者，禁忌使用吗啡等止痛药物（B错），以免掩盖病情，延误诊断和治疗。